蛋白激酶A的作用是使
A. 蛋白质水解
B. 蛋白质的特定丝氨酸
C. 蛋白质或酶脱磷酸
D. 酶降解失活
E. 蛋白质合成

正确答案：B。蛋白质的特定丝氨酸

解析：蛋白激酶A（PKA），在ATP存在下，活化的PKA可使许多蛋白质的特定丝氨酸或苏氨酸残基磷酸化，从而调节细胞的物质代谢和基因表达。掌握“各信号分子及转导机制”知识点。